哺乳期妇女禁用的药品是
A. 诺氟沙星
B. 复方铝酸铋
C. 青霉素
D. 多潘立酮
E. 碳酸钙

正确答案：A。诺氟沙星

解析：本题考查哺乳期妇女用药。哺乳期妇女禁用的抗感染药物有诺氟沙星（A对）、环丙沙星、氧氟沙星、左氧氟沙星、培氟沙星、依诺沙星、洛美沙星、氟罗沙星、链霉素、氯霉素、林可霉素、米诺环素、多西环素、磺胺嘧啶、磺胺甲噁唑、磺胺异噁唑、特比萘芬、伊曲康唑、两性霉素B、利巴韦林、膦甲酸钠、阿苯达唑、替硝唑、乙胺嘧啶。复方铝酸铋（B错）服药期间大便呈黑色属正常现象，如排稀便可适当减量；如患者胃酸不足，可适当加用助消化药物；服药不可间断，即使自觉症状减轻或消失，仍应继续服药，直至完成1个疗程。青霉素（C错）适用于革兰阳性球菌所致的各种感染，对青霉素或其他青霉素类药过敏者禁用。多潘立酮（D错）属于促动力药，尽管动物实验中尚未发现本药有致畸作用和胎盘毒性，但孕妇用药应权衡利弊，谨慎使用。碳酸钙（E错）属于抗骨质疏松药。